关于犁骨的描述，正确的是
A. 左右各一
B. 位于筛板紧下方
C. 构成骨性鼻中隔上部
D. 构成骨性鼻中隔下部
E. 属于脑颅骨

正确答案：D。构成骨性鼻中隔下部

解析：犁骨为斜方形骨板，组成骨性鼻中隔后下份（D对C错）。面颅有 15 块骨 。 成对的包括上颌骨、腭骨、颧骨、鼻骨、泪骨及下鼻甲，不成对的有犁骨、下颌骨和舌骨（E错）。